（牙合）片使用
A. 5cm×7cm胶片
B. 6cm×8cm胶片
C. 5cm×6cm胶片
D. 6cm×7cm胶片
E. 7cm×8cm胶片

正确答案：B。6cm×8cm胶片

解析：本题考查牙合片。牙合片使用6cm×8cm胶片（B对）。牙合片投照技术原则与根尖片基本相同，适用于检查根尖片不能包括的范围较大的病变。横断牙合片投照原则是X线与被检查牙齿的长轴平行。牙合片使用6cm×8cm胶片。